男，66岁。食用坚果后突发呕血4小时，伴心悸、胸闷、气短。既往慢性乙型肝炎病史20年，冠心病史8年。查体：BP90/50mmHg，心率110次/分，心律不齐，早搏10次/分。最适合的治疗药物是
A. 西咪替丁
B. 硝酸甘油
C. 普萘洛尔
D. 血管加压素
E. 生长抑素

正确答案：E。生长抑素

解析：老年男性患者，既往慢性乙型肝炎病史20年（肝硬化的高危因素），冠心病史8年。食用坚果（上消化道出血诱因）后突发呕血（出现上消化道出血），伴心悸、胸闷、气短，查体：BP90/50mmHg（正常值>90/60mmHg，提示存在失血性休克），心率110次/分（正常值60～100次/分，提示心率过快，失血过多的表现），心律不齐，早搏10次/分（冠心病患者大量呕血，心肌缺血缺氧，诱发早搏），综合患者的病史、查体，可初步诊断为肝硬化并发食管胃底静脉曲张出血伴早搏。食管胃底静脉曲张出血通常出血量大、死亡率高，患者现在的主要治疗目的是控制出血。生长抑素（E对）是一种血管活性药物，可以有效减少门静脉血流量，降低门静脉压，从而止血。且因不伴全身血流动力学改变，短期使用无严重不良反应，为治疗食管胃底静脉曲张出血的最常用药物。西咪替丁（A错）是H₂受体拮抗剂，可以减少胃酸对曲张静脉壁的损伤；普萘洛尔（C错）为非选择性β受体拮抗剂，通过收缩食管-胃底血管，减少食管-胃底高动力循环，二者主要用于食管胃底静脉曲张出血的一级预防。硝酸甘油（P225）（B错）为内皮依赖性血管扩张剂，主要用于稳定型心绞痛缓解期的治疗。血管加压素（D错）又称抗利尿激素，主要用于治疗尿崩症和肺出血。